下列各项中，不属于产后尿潴留气虚证主要症状的是
A. 产后小便不通
B. 小腹胀急疼痛
C. 气短懒言
D. 面色晦黯
E. 舌淡、苔薄白，脉缓弱

正确答案：D。面色晦黯

解析：产后尿潴留气虚证因素体气虚或产时失血耗气，或新产忧思劳累过度，肺脾之气亦虚，无力通调水道，专属水液，水液停滞脬中，膀胱气化不利，故见产后小便不通（A对），小腹胀急疼痛（B对）或小便清白，点滴而下；气虚中阳不振，故倦怠乏力，气短懒言（C对）；产后气虚血亦亏，不能上荣于面，则面色少华；舌淡，苔薄白，脉缓弱（E对），为气虚血亏之征。面色晦暗（D错，为本题正确答案）是肾虚症状。